下列关于冠状动脉描述，正确的是
A. 是营养心的血管
B. 发自肺动脉干起始部
C. 走在前、后室间沟内
D. 只有一条
E. 仅分布于左、右心室壁

正确答案：A。是营养心的血管

解析：冠状动脉是营养心的血管（A对），心的血液供应来自左、右冠状动脉。